主要发生于小涎腺，中年以上女性多见，被称为终末导管癌、小叶癌的恶性肿瘤是
A. 恶性多形性腺瘤
B. 腺泡细胞癌
C. 黏液表皮样癌
D. 腺样囊性癌
E. 多形性低度恶性腺癌

正确答案：E。多形性低度恶性腺癌

解析：多形性低度恶性腺癌又称为终末导管癌，小叶癌。主要发生于小唾液腺，约60%发生于腭部。中年以上女性稍多见。常表现为缓慢生长的无痛性肿块，偶见表面黏膜毛细血管扩张、出血或溃疡。掌握“腺泡细胞癌”知识点。